女，48岁。皮肤瘙痒，皮肤巩膜黄染5年，血清总胆红素320umol/L，经检查发现胃十二指肠粘连，行胃十二指肠切除术。哪种物质吸收不包括在内
A. 铁
B. 维生素C
C. 钙
D. 维生素D
E. 维生素K

正确答案：E。维生素K

解析：患者女，皮肤瘙痒，皮肤巩膜黄染，总胆红素高（正常值3.4～17.1μmol/L， 17.1～34.2μmol/L可视为隐性黄疸；34.2～170μmol/L之间为轻度黄疸；170～340μmol/L为中度黄疸；大于340μmol/L则为重度黄疸），提示胆汁分泌受阻，发现胃十二指肠粘连，行胃十二指肠切除术。此题主要考察各种物质的吸收部位，铁（A对）、钙（C对）和维生素C（B对）主要在小肠上部即十二指肠和空肠近段被吸收，胃十二指肠切除影响其吸收。脂溶性维生素D（D对）随脂溶性物质经小肠绒毛上皮细胞一同吸收（九版生理学P236）。维生素K（E错，为本题正确答案）在大肠吸收（九版生理学P206）。